舒张压加1/3脉压称为
A. 收缩压
B. 舒张压
C. 脉压
D. 平均动脉压
E. 中心静脉压

正确答案：D。平均动脉压

解析：舒张压加1/3脉压称为平均动脉压（D对）。收缩压（A错）是指心室收缩期中期时达到最高值时的血压。舒张压（B错）是指心室舒张末期动脉血压达最低值时的血压。脉压（C错）是指收缩压和舒张压的差值。中心静脉压（E错）是指右心房和胸腔内大静脉血压。